有关癌基因与抑癌基因的作用机制是
A. 控制的细胞分裂和分化过程
B. 与癌基因表达无关
C. 缺失对细胞的增殖、分化无影响
D. 不存在于人类正常细胞
E. 肿瘤细胞出现时才进行表达

正确答案：A。控制的细胞分裂和分化过程

解析：癌基因与抑癌基因的作用机制涉及信号转导、基因表达调控以及其控制的细胞分裂和分化过程。掌握“癌基因与抑癌基因以及生长因子”知识点。